传染性软疣的外治，应选用
A. 推疣法
B. 浸渍法
C. 针挑法
D. 挖除法
E. 结扎法

正确答案：C。针挑法

解析：传染性软疣，中医称之为鼠乳，多见于儿童，皮损为半球形丘疹，米粒到黄豆、豌豆大小，中央有脐凹，表面有蜡样光泽，挑破顶端可挤压出白色乳酪样物质，数目不定，数个到数十个不等，呈散在性或簇集性分别，好发于躯干和面部，本病例皮疹特点、发病年龄和发病部位与之相符，外治法为用消毒针头挑破患处，挤尽白色乳酪样物，再用碘酒或浓石碳酸溶液点患处（C对）。推疣法适用于寻常疣（A错）。浸渍法不属于疣的外治方法（B错）。挖除法适用于掌跖疣（D错）。结扎法适用于丝状疣（E错）。